因使用过硬的橡皮奶头人工喂养，导致婴儿硬软腭交界处黏膜出现溃疡，称为
A. Bednar溃疡
B. Riga-Fede溃疡
C. 腺周口疮
D. 创伤性溃疡
E. 结核性溃疡

正确答案：A。Bednar溃疡

解析：本题考查创伤性溃疡的临床表现。因使用过硬的橡皮奶头人工喂养，导致婴儿硬软腭交界处黏膜出现溃疡，称为Bednar溃疡（A对）。Bednar溃疡由婴儿吮吸拇指或过硬的橡皮奶头引起，固定发生于硬腭、双侧翼钩处黏膜表面，双侧对称性分布；Riga-Fede溃疡专指发生于儿童舌腹的溃疡（B错）；腺周口疮即重型复发性阿弗他溃疡，好发于口角（C错）；创伤性溃疡为压疮性溃疡、Bednar溃疡、Riga-Fede溃疡、自伤性溃疡、化学灼伤性溃疡、热灼伤性溃疡的总称（D错）；口腔中常见继发性结核损害是结核性溃疡（E错），好发于舌部。